《中国药典》中，检查甲苯咪唑（C晶型）中A晶型限量的方法是
A. 紫外-可见分光光度法
B. 红外分光光度法
C. 氧化还原滴定法
D. 酸碱滴定法
E. 非水溶液滴定法

正确答案：B。红外分光光度法

解析：本题考查常用的药品鉴别方法。《中国药典》中，检查甲苯咪唑（C晶型）中A晶型限量的方法是红外分光光度法（B对）。由于C晶型与A晶型在640cm⁻¹和662cm⁻¹两波长处吸收度的比值不同，所以可用红外分光光度法检查甲苯咪唑（C晶型）中A晶型限量。紫外-可见分光光度法（A错）适用于具有共轭双键结构药物的鉴别。氧化还原滴定法（C错）、酸碱滴定法（D错）、非水溶液滴定法（E错）均为容量分析法，常用于原料药的含量测定。